“乙癸同源”的“乙癸”所指的脏是
A. 心、脾
B. 肝、肺
C. 脾、肾
D. 心、肾
E. 肝、肾

正确答案：E。肝、肾

解析：肝藏血，肾藏精，精血同源于水谷精微，且能互相转化滋生，故“精血同源”，又称“乙癸同源”（E对）。心与脾（A错）的关系，主要表现在血液生成与运行的相互作用、相互协调。肺与肝（B错）的关系，主要表现在人体气机升降调节方面。脾与肾（C错）的关系，主要表现在先天和后天相互滋生与津液代谢方面。心与肾（D错）的关系主要表现在“心肾相交”，包括水火既济，精神互用，君相安位。